有根尖瘘管的患牙根充后桩核冠修复开始的时机一般是
A. 无叩痛后
B. 瘘管闭合后
C. 无根尖区扪痛后
D. 无自觉症状时
E. 根充后1周

正确答案：B。瘘管闭合后

解析：根管充填后选择桩核冠修复的时间参考治疗情况和全身状况而定。一般完善的根管治疗后，观察1～2周，无临床症状后可以开始修复；原牙髓正常或牙髓炎未累及根尖者，观察时间可短，根管治疗3天后无症状，可开始修复；有瘘管的患牙需在治疗愈合后进行修复；有根尖周炎的患牙，一般需在根管治疗后观察1周以上，没有临床症状，进行修复；如果根尖病变较广泛者，需在治疗后较长时间观察，待根尖病变明显缩小形成骨硬板后才能修复。掌握“牙体缺损修复体固位及适应、禁忌证”知识点。